溴化苯在体内代谢为环氧化物后成为肝脏毒物。如事先给予实验动物SKF-525A，则溴化苯的肝毒性明显降低，原因是抑制了
A. 黄素加单氧酶
B. 谷胱甘肽转移酶
C. 环氧化物水化酶
D. 超氧化物歧化酶
E. 混合功能氧化酶

正确答案：E。混合功能氧化酶